关于筛检试验的评价指标下列哪项是正确的
A. 试验的灵敏度愈高阳性预测值愈高
B. 试验的特异度愈高阴性预测值愈高
C. 试验阳性预测值上升，试验阴性预测值随之上升
D. 现患率降低，试验阳性预测值降低
E. 现患率降低，试验阴性预测值降低

正确答案：D。现患率降低，试验阳性预测值降低

解析：本题考查预测值与真实性指标、现患率的关系。预测值与真实性指标、现患率的关系为：①现患率对预测值的影响，当灵敏度与特异度一定，疾病患病率降低，阳性预测值降低（D对），阴性预测值升高（E错）；②灵敏度、特异度对预测值的影响：当人群患病率不变时，灵敏度升高，特异度降低，阳性预测值下降（A错），阴性预测值升高（BC错）。